对于射线灭菌法的原理和应用，下列说法不准确的是
A. 放射源是钴60产生的γ射线
B. 能够损伤微生物的核酸和酶类进行物理灭菌
C. 优点是穿透力强、灭菌可靠和不使物品升温等优点
D. 可以广泛用于一次性塑料、乳胶医用品等的灭菌处理
E. 能够损伤细菌DNA导致细菌死亡

正确答案：E。能够损伤细菌DNA导致细菌死亡

解析：辐射灭菌是利用专用设施放射源钴60（60Co）产生的γ射线，通过损伤微生物的核酸及酶类的物理灭菌方法，具有穿透力强、灭菌可靠和不使物品升温等优点。它日益被广泛应用于一次性塑料、乳胶医用品，等不耐热医用品，精密仪器等的灭菌处理。掌握“消毒与灭菌”知识点。